患者，女，36岁。既往健康。30分钟前家人发现其神志不清。检查发现呕吐物有蒜臭味、多汗、双侧瞳孔缩小。应首先考虑的诊断是
A. 脑血管意外
B. 肝昏迷
C. 有机磷农药中毒
D. 安眠药中毒
E. 毒蕈中毒

正确答案：C。有机磷农药中毒

解析：患者既往体健，30分钟前家人发现其神志不清，检查发现呕吐物有蒜臭味、多汗、双侧瞳孔缩小，与有机磷中毒表现相符，故应首先考虑的诊断是有机磷中毒（C对）。脑血管意外主要表现为猝然昏倒、不省人事、伴发口角歪斜、语言不利而出现半身不遂等症状（A错）。肝昏迷是肝性脑病的最后阶段，主要表现为性格及行为改变、嗜睡、扑翼样震颤、呼出气有烂苹果味儿等（B错）。安眠药中毒主要表现为嗜睡、神志恍惚甚至昏迷、言语不清、瞳孔缩小、共济失调、腱反射减弱或消失等（D错）。毒蕈中毒主要表现为恶心、呕吐、腹痛、腹泻、昏迷、晕厥等（E错）。